为预防风湿热复发，长效青霉素注射时间至少持续
A. 3年
B. 1年
C. 5年
D. 2年
E. 4年

正确答案：C。5年

解析：风湿热的预后主要取决于心脏炎的严重程度、首次发作时是否得到正确的抗风湿热治疗以及是否采取正规抗链球菌治疗。为预防风湿热发作，长效青霉素注射时间至少持续5年，最好持续至25岁，目的是是彻底的清除链球菌（C对）。